男，78岁，反复咳嗽、咳痰50年，心悸、气促10年，再发10天。吸烟40年，30支/日。查体：T36.0℃，P120次/分，R32次/分，BP135/80mmHg，SpO₂87%。桶状胸，肋间隙增宽，两侧呼吸运动对称，触觉语颤减低，胸部叩诊呈过清音，双肺呼吸音减弱，双肺可闻及细湿啰音和少量哮鸣音。动脉血气分析示pH7.398，PaO₂50.4mmHg，PaCO₂56.8mmHg，肺功能检查：FEV₁占预计值27%，FEV₁/FVC34%，该患者不宜吸入高浓度氧的原因是高浓度可解除
A. 外周化学感受器对低氧存在的适应现象
B. 低氧对呼吸中枢的直接兴奋作用
C. 中枢化学感受器对低氧存在的适应现象
D. 低氧对外周化学感受器的兴奋作用
E. 低氧对中枢化学感受器的兴奋作用

正确答案：D。低氧对外周化学感受器的兴奋作用

解析：患者老年男性，反复咳嗽、咳痰50年（患有老慢支基础病），心悸、气促10年，再发10天。吸烟40年，30支/日。桶状胸，肋间隙增宽，两侧呼吸运动对称，触觉语颤减低，胸部叩诊呈过清音（为肺气肿的表现），双肺呼吸音减弱，双肺可闻及细湿啰音和少量哮鸣音（并发哮喘）。肺功能检查：FEV₁占预计值27%（正常值＞80%，降低提示阻塞性通气障碍），FEV₁/FVC34%（正常值＞70%，降低提示阻塞性通气障碍），动脉血气分析示pH7.398（正常值7.35～7.45），PaO₂50.4mmHg（正常值95～100mmHg，降低提示弥散障碍），PaCO₂56.8mmHg（正常值35～45mmHg，升高提示阻塞性通气障碍），诊断慢性二型呼衰。氧疗应持续低流量吸氧。患者不宜吸入高浓度氧的原因是高浓度可解除低氧对外周化学感受器的兴奋作用（D对），与外周化学感受器对低氧存在的适应现象（A错）无关，对高浓度氧存在适应现象。低氧对中枢感受器影响很小（BCE错）。